妊娠瘤大，需手术治疗时，手术的时机应尽量选择在
A. 妊娠第1～3个月切除
B. 妊娠第2～5个月切除
C. 妊娠第4～6个月切除
D. 妊娠第5～7个月切除
E. 妊娠第7～9个月切除

正确答案：C。妊娠第4～6个月切除

解析：对一些体积较大的妊娠期龈瘤，若已妨碍进食，则可考虑手术切除。手术时机应尽量选择在妊娠期的4～6个月内，以免引起流产或早产。术中应避免流血过多，术后应严格控制菌斑，以防复发。掌握“妊娠期龈炎”知识点。